义齿边缘不能较多伸展的区域是
A. 牙槽嵴
B. 远中颊角区
C. 颊侧翼缘区
D. 上颌结节
E. 颧突

正确答案：B。远中颊角区

解析：本题考查无牙颌的解剖标志-远中颊角区。远中颊角区（B对）基托边缘不能较多伸展，否则会引起疼痛，干扰咬肌活动，使义齿上升松动。牙槽嵴（A错）是承担咀嚼压力最主要的部分，能承担较大咀嚼压力，故义齿边缘应充分伸展。颊侧翼缘区（C错）的面积较大，骨质致密，当牙槽嵴吸收严重时，此区较为平坦，骨小梁排列与（牙合）力方向几乎呈直角，义齿基托在此区内可有较大范围的伸展以分散（牙合）力，保护黏膜组织。在上颌结节（D错）的颊侧，基托边缘应伸展到颊间隙内，以利固位。颧突（E错）位于后牙弓，有颊肌覆盖，表面黏膜较薄，与之相应的基托应适当缓冲，否则会出现压痛或使义齿以此为支点前后翘动。